女，35岁。腹泻、纳差、乏力、发热5月余。大便为黄色糊状，无粘液及脓血，3～5次/日，体温37.5～38℃。发病以来体重减轻约8kg。下列辅助检查最有助于明确诊断的是
A. 腹部CT
B. 结肠镜及黏膜活组织病理检查
C. 胶囊内镜
D. 下消化道X线钡剂造影
E. PPD试验

正确答案：B。结肠镜及黏膜活组织病理检查

解析：青壮年女性，腹泻、纳差、乏力、发热5月余，大便为黄色糊状，，无粘液及脓血，体重下降。提示肠结核。结肠镜及黏膜活组织病理检查对肠结核有确诊意义（B对）；腹部CT对肠结核的诊断无太大意义（A错）；胶囊内镜主要用于检查胃镜和结肠镜不能到达的小肠盲区，肠结核主要位于回盲部，一般采用结肠镜检查，且肠结核通常导致肠腔狭窄，故不宜使用胶囊内镜（C错）；下消化道X线钡剂造影对肠结核的诊断有很大帮助，但与结肠镜及黏膜活组织病理检查相比，下消化道X线钡剂造影的准确性相对较低（D错）；结核菌素试验（PPD）阳性也见于正常人，对肠结核的诊断无太大意义（E错）。